按现行（FIGO，1998）的子宫内膜癌手术分期标准，Ⅱ期是
A. 侵犯肌层＞1/2
B. 累及宫颈粘膜腺体
C. 侵犯宫颈间质
D. 侵犯子宫浆膜层
E. 盆腔淋巴结或阴道转移

正确答案：C。侵犯宫颈间质

解析：按现行（FIGO，2009）的子宫内膜癌手术分期标准，①Ⅰ期 肿瘤局限于子宫体；ⅠA 肿瘤浸润深度＜1/2肌层；ⅠB 肿瘤浸润深度≥1/2肌层（A错）。②Ⅱ期 肿瘤侵犯宫颈间质（C对），但无宫体外蔓延。③Ⅲ期 肿瘤局部和（或）区域扩散；ⅢA 肿瘤累及浆膜层（D错）和（或）附件；ⅢB 阴道和（或）宫旁受累；ⅢC 盆腔淋巴结和（或）腹主动脉旁淋巴结转移，ⅢC1 盆腔淋巴结阳性（E错），ⅢC2 腹主动脉旁淋巴结阳性伴（或不伴）盆腔淋巴结阳性。④Ⅳ期 肿瘤侵及膀胱和（或）直肠粘膜和（或）远处转移；ⅣA 肿瘤侵及膀胱和（或）直肠粘膜；ⅣB 远处转移，包括腹腔内和（或）腹股沟淋巴结转移。累及宫颈粘膜腺体（B错）为以前子宫内膜癌手术分期标准的ⅡA期。